抗菌谱广，活性强，毒性低，疗效可与第三、四代头孢菌素媲美的抗菌药是
A. 诺氟沙星
B. 盐酸小檗碱
C. 磺胺甲噁唑
D. 环丙沙星
E. 吡哌酸

正确答案：A、D。诺氟沙星；环丙沙星

解析：本题考查氟喹诺酮类抗菌药。诺氟沙星（A对）和环丙沙星（D对）为氟喹诺酮类抗菌药物，该类药既有抗革兰阳性菌的活性，又明显增强抗革兰阴性菌的活性，疗效可与第三、四代头孢菌素媲美。盐酸小檗碱（B错）主要用于肠道感染及菌痢等。磺胺甲噁唑（C错）主治大肠杆菌和变形杆菌引起的急性、慢性尿路感染，脑膜炎球菌所致流行性脑脊髓膜炎的预防以及流感杆菌所致的中耳炎等。吡哌酸（E错）对革兰阴性杆菌有较好的抗菌作用。